环孢素测定血药峰浓度的时间是
A. 肾脏毒性
B. 服药后2小时
C. 心脏毒性
D. 服药后8小时
E. 早晨服药前

正确答案：B。服药后2小时

解析：本题考查环孢素的代谢。环孢素测定血药峰浓度的时间是服药后2小时（B对）。